急性支气管肺炎的主要病原体是
A. 肺炎支原体
B. 疱疹病毒
C. 呼吸道合胞病毒
D. 肺炎双球菌
E. 柯萨奇病毒

正确答案：D。肺炎双球菌

解析：急性支气管肺炎的主要病原体是肺炎双球菌（D对）。肺炎支原体、柯萨奇病毒可引起上呼吸道感染（A错）。疱疹病毒引起带状疱疹（B错）急性毛细支气管炎喘憋性肺炎的主要病原体是呼吸道合胞病毒，多见于2～6个月婴儿，血清病毒抗体检测或咽拭分离有助于诊断（C错）。引起疱疹性咽峡炎的病原体是柯萨奇病毒（E错）。